以下不是淋巴器官的有
A. 淋巴结
B. 胸腺
C. 扁桃体
D. 淋巴组织
E. 无

正确答案：D。淋巴组织

解析：淋巴器官包括淋巴结（A对）、脾、胸腺（B对），扁桃体（C对）。淋巴管道、淋巴组织（D错，为本题正确答案）和淋巴器官共同组成淋巴系统。